患者，男，23岁，因近日脚趾间瘙痒、有明显脱皮就诊，诊断为足癣。关于该患者用药指导和健康教育的说法，错误的是
A. 应注意保持鞋袜、足部清洁干燥
B. 不与他人共用生活物品，如指甲刀、拖鞋等，以免交叉传染
C. 可使用咪康唑、酮康唑或特比萘芬等局部抗真菌药治疗
D. 使用局部抗真菌药，症状消失1～2天后即可停药
E. 在局部用药期间，用温水清洗患处皮肤，尽量少用或不用肥皂

正确答案：D。使用局部抗真菌药，症状消失1～2天后即可停药

解析：本题考查用药指导和健康教育。手足真菌治疗须足量、足疗程：一般治疗体、股癣需2～4周，足癣需1个月，甲癣需3～6个月。使用外用药物症状消失后，真菌仍然存活在皮肤鳞屑或贴身衣物中，遇到潮暖环境又会大量繁殖，导致癣病复发。因此，表面症状消失后，仍要坚持用药1～2周（D错，为本题正确答案）。手、足癣，尤其是足癣容易复发或再感染。患者须注意个人卫生和健康管理：①手、足部洗浴后应及时擦干趾（指）间，穿透气性好的鞋袜，手、足避免长期浸水，掌跖出汗多时可局部使用抑汗剂或抗真菌散剂，保持鞋袜、足部清洁、干燥（A对）。②注意浴池、宿舍等场所的公共卫生，不与他人共用日常生活物品，如指甲刀、鞋袜、浴盆和毛巾等（B对）。③积极治疗自身其他部位的癣病（特别是甲癣），同时还需治疗家庭成员、宠物的癣病。④在外用药物期间，对患部皮肤尽量少用或不用肥皂和碱性药物，仅用温水清洗（E对），以延长抗真菌药在体表停留的时间而巩固和提高疗效。⑤糖尿病患者或肥胖患者应控制好基础疾病。手足真菌可使用咪康唑、酮康唑或特比萘芬等局部抗真菌药治疗（C对）。